急性肾衰竭的防治原则中包括
A. 控制原发病
B. 合理用药
C. 纠正酸中毒
D. 控制氮质血症
E. 以上都相关

正确答案：E。以上都相关

解析：急性肾衰竭的防治原则中包括：1.积极治疗原发病（A对）或控制致病因素；2.纠正内环境紊乱：①纠正水和电解质紊乱②处理高钾血症③纠正代谢性酸中毒（C对）④控制氮质血症（D对）⑤透析治疗；3.抗感染和营养支持；4.针对发生机制合理用药（B对）。综上，以上都相关（E对）。